白芷为治疗何种头痛要药
A. 阳明经头痛
B. 太阳经头痛
C. 少阳经头痛
D. 肝经头痛
E. 少阴经头痛

正确答案：A。阳明经头痛

解析：白芷归肺、胃、大肠经，其应用于头痛，牙痛风湿痹痛。本品辛散温通，长于止痛，且善入足阳明胃经，治疗阳明经额痛以及牙龈肿痛尤为多用（A对）。太阳经头痛常用羌活（B错）。少阳经头痛常用川芎（C错）。巅顶头痛常用藁本（D错）。少阴经头痛常用独活、细辛（E错）。